关于青光眼的说法，正确的是
A. 治疗闭角型青光眼主要使用降低眼压药物
B. 推荐长期口服β受体阻断剂降低眼压
C. 长期使用卡替洛尔滴眼液会导致近视趋势
D. 不能联合使用两种机制不同的降眼压药治疗青光眼
E. 拉坦前列素可以治疗儿童先天性青光眼

正确答案：C。长期使用卡替洛尔滴眼液会导致近视趋势

解析：本题考查青光眼。长期使用卡替洛尔滴眼液会导致近视趋势（C对）。卡替洛尔的缺点是在滴眼后0.5～3小时内，伴随缩瞳同时可产生暗黑感、远视障碍，调节痉挛，长期用药可引起近视化倾向。青光眼的种类主要有以下四种：先天性青光眼，原发性青光眼，继发性青光眼，混合型青光眼。各种类型的青光眼的临床表现及特点均不相同。治疗开角型青光眼主要使用降低眼压药物（A错）。长期口服β受体阻断剂不良反应较大，一般不推荐长期口服β受体阻断剂降低眼压（B错）。可以联合使用两种机制不同的降眼压药治疗青光眼（D错）。拉坦前列素属于前列腺素类似物，儿童不能使用，故拉坦前列素不可以治疗儿童先天性青光眼（E错）。